男，45岁，从高处坠落伤7小时，伤后未排尿，查体：神志清，BP80/55mmHg，血氧饱和度90%，颈部、背部、腰部、胸部无压痛，P122次/分，腹部无压痛、肌紧张，上肢感觉活动正常，骨盆分离挤压试验（+），髋关节活动受限，大腿见多处皮肤擦伤并有沙粒污染，下肢感觉运动正常，入院后首先要进行的处理是
A. 立即留置导尿
B. 临时固定骨盆
C. 立即清创，防止创面感染
D. 立即开通静脉补液通路
E. 立即完善相关检查，明确诊断

正确答案：D。立即开通静脉补液通路

解析：该患者有高空坠落史，出现血压下降（提示有大量出血），骨盆分离挤压试验阳性，髋关节活动受限，大腿见多处皮肤擦伤并有砂砾污染，结合患者病史、临床表现和体查，该患者最有可能的诊断为骨盆骨折。患者心率为122次/分，血压80/50mmHg，休克指数：122/80=1.5，提示中度休克，须立即开通静脉补液通路（D对）避免循环衰竭。因患者不能自主排尿，应留置导尿；固定骨盆，等待进一步检查与治疗；及时清创，防止创面感染；以及应完善相关检查，明确诊断。但这些措施都应在建立静脉补液通路的基础上进行（ABCE错）。